管理毒理学是指
A. 政府有关机构根据描述性和机制研究资料，作出是否允许人工合成的新化学物进入人类环境的判断和决定
B. 提出相应的安全使用（接触）标准和管理措施
C. 按照政策法令对现存的外源性毒物进行管理和控制
D. 参与政策法令的制定并且履行监督和执法职能
E. 以上都是

正确答案：E。以上都是